治疗肺结核阴阳两虚型，应首选
A. 补天大造丸
B. 泻白散合黛蛤散
C. 百合固金汤
D. 保真汤
E. 月华丸

正确答案：A。补天大造丸

解析：肺结核阴阳两虚证的病机是肺痨日久，阴伤及阳，肺脾肾三脏并损，故治宜滋阴补阳、补脏腑虚损，方药用滋阴补阳的补天大造丸加减（A对）。泻白散合黛蛤散（B错）可清泻肝胃之火，用于治疗肝火犯肺证。百合固金汤（C错）可滋阴降火，用于治疗阴虚火旺证。保真汤（D错）可益气养阴，用于治疗气阴耗伤证。月华丸（E错）可滋阴润肺，用于治疗肺阴亏损证。